代谢性酸中毒常伴有高血钾是由于肾小管
A. H⁺-Na⁺交换减弱
B. H⁺-K⁺交换增强
C. K⁺-Na⁺交换减弱
D. K⁺重吸收增加
E. NH4⁺-K⁺交换减弱

正确答案：C。K⁺-Na⁺交换减弱